采集应坚持“最大持续产量”原则的是
A. 道地药材
B. 鲜用药材
C. 野生或半野生药用动植物
D. 自采自种自用中草药

正确答案：C。野生或半野生药用动植物

解析：本题考查的是野生或半野生药用动植物。采集应坚持“最大持续产量”原则的是野生或半野生药用动植物（C对）。中药材采集应坚持“最大持续产量”原则，野生或半野生药用动植物的采集应坚持“最大持续产量”原则，“最大持续产量”即不危害生态环境，可持续生产（采收）的最大产量。道地药材（A错）：源自特定产区、具有独特药效，需要在特定地域内生产。鲜用药材（B错）：可采用冷藏、砂藏、罐贮、生物保鲜等适宜的保鲜方法，尽可能不使用保鲜剂和防腐剂。自采自种自用中草药（D错）：自种、自采、自用中草药是指乡村中医药技术人员自己种植、采收、使用，不需特殊加工炮制的植物中草药。